会造成药物半衰期（t1/2）延长的情况有
A. 新生儿和早产儿
B. 长期使用脂溶性药物的肥胖患者
C. 胃肠功能系乱的患者
D. 肾功能损害的患者
E. 70岁以上的老年人

正确答案：A、B、C、D、E。新生儿和早产儿；长期使用脂溶性药物的肥胖患者；胃肠功能系乱的患者；肾功能损害的患者；70岁以上的老年人